茎表面密被覆瓦状排列的肉质鳞叶，断面有淡棕色点状维管束排列成波状环纹的药材是
A. 鱼腥草
B. 紫花地丁
C. 穿心莲
D. 淡竹叶
E. 肉苁蓉

正确答案：E。肉苁蓉

解析：本题考查的是肉苁蓉药材的性状鉴别。茎表面密被覆瓦状排列的肉质鳞叶，断面有淡棕色点状维管束排列成波状环纹的药材是肉苁蓉（E对）。肉苁蓉：【性状鉴别】药材呈扁圆柱形，稍弯曲。表面棕褐色或灰棕色，密被覆瓦状排列的肉质鳞叶，通常鳞叶先端已断。体重，质硬，微有柔性，不易折断，断面棕褐色，有淡棕色点状维管束排列成波状环纹。气微，味甜、微苦。鱼腥草（A错）：【性状鉴别】药材鲜鱼腥草茎呈圆柱形；上部绿色或紫红色，下部白色，节明显，下部节上生有须根，无毛或被疏毛。叶互生，叶片心形；先端渐尖，上表面绿色，密生腺点，下表面常紫红色；叶柄细长，基部与托叶合生成鞘状。穗状花序顶生。具鱼腥气，味涩。紫花地丁（B错）：【性状鉴别】药材多皱缩成团。主根长圆锥形；淡黄棕色，有细纵皱纹。叶基生，灰绿色，展平后叶片呈披针形或卵状披针形；先端钝，基部截形或稍心形，边缘具钝锯齿，两面有毛；叶柄细，上部具明显狭翅。花茎纤细；花瓣5，紫堇色或淡棕色；花距细管状。蒴果椭圆形或3裂，种子多数，淡棕色。气微，味微苦而稍黏。穿心莲（C错）：【性状鉴别】药材茎呈方柱形，多分枝，节稍膨大；质脆，易折断。单叶对生，叶柄短或近无柄；叶片皱缩、易碎，完整者展开后呈披针形或卵状披针形，先端渐尖，基部楔形下延，全缘或波状；上表面绿色，下表面灰绿色，两面光滑。气微，味极苦。淡竹叶（D错）：【性状鉴别】药材茎呈圆柱形，有节，表面淡黄绿色，断面中空。叶鞘开裂。叶片披针形，有的皱缩卷曲；表面浅绿色或黄绿色。叶脉平行，具横行小脉，形成长方形的网格状，下表面尤为明显。体轻，质柔韧。气微，味淡。